直接影响基因转录的蛋白质是
A. 载脂蛋白
B. 脂蛋白
C. 血红蛋白
D. 白蛋白
E. 组蛋白

正确答案：E。组蛋白

解析：在真核细胞中，核小体是染色质的主要结构单位，四种组蛋白（E对）组成的八聚体构成核小体的核心区，直接影响基因转录。载脂蛋白（A错）是血浆脂蛋白中的蛋白质部分，能够结合和运输血脂到机体各组织进行代谢及利用的蛋白质。脂蛋白（B错）主要参与细胞外脂质的包装、储存、运输和代谢。血红蛋白（C错）又称血色素，是红细胞的主要组成部分。白蛋白（D错）又称清蛋白，是人体血浆中最主要的蛋白质，维持机体营养与渗透压。